女，50岁。腹痛伴剧烈呕吐2天，诊断为轻症急性胰腺炎，身高160cm，体重60Kg，予禁食，按基本需要量计算全胃肠外营养，其每天需要的总热量约为
A. 1200kcal
B. 2000kcal
C. 2800kcal
D. 1600kcal
E. 2400kcal

正确答案：D。1600kcal

解析：该患者女，50岁，诊断轻症急性胰腺炎…，结合患者的情况，根据公式计算得出每天需要的总热量为1600kcal（D对）。